以下哪种肿瘤含类似于成釉细胞瘤的上皮成分和可发生钙化的影细胞
A. 牙源性钙化囊性瘤
B. 成釉细胞瘤
C. 牙源性钙化上皮瘤
D. 成釉细胞纤维瘤
E. 牙源性角化囊性瘤

正确答案：A。牙源性钙化囊性瘤

解析：牙源性钙化囊性瘤含类似于成釉细胞瘤的上皮成分和可发生钙化的影细胞，后者可发生钙化。掌握“牙源性钙化上皮、囊性瘤”知识点。